范德华力占金-瓷结合力的
A. 0.6
B. 0.49
C. 0.26
D. 0.22
E. 0.03

正确答案：E。0.03

解析：范德华力：从理论上分析，金属与瓷之间熔融结合后，会产生紧密贴合后的分子间的引力，即范德华力。但这种力属于弱电力，仅占金-瓷结合力的3%。掌握“修复材料、金瓷结合及树脂粘结机制”知识点。